女孩，8岁。浮肿，尿少3天入院，神清，眼睑浮肿明显，双下肢非凹陷性水肿，血压140/90mmHg，心肺无异常。该患儿最可能的诊断是
A. 急性泌尿系感染
B. 急性肾小球肾炎
C. 急进性肾炎
D. 肾炎性肾病
E. 单纯性肾病

正确答案：B。急性肾小球肾炎

解析：患者眼睑浮肿明显，双下肢非凹陷性水肿，尿少，初步诊断为急性肾小球肾炎（B对）。急性泌尿道感染的年长儿以发热、寒战、腹痛等全身症状突出，常有腰痛和肾区叩击痛、肋脊角压痛等（A错）。肾病综合症以水肿最常见，开始于眼睑，以后逐渐遍及全身，呈凹陷性（CD错）。单纯性肾病（IgA肾病）以血尿为主要症状（E错）。